哌醋甲酯用于治疗儿童多动症时，每张处方不得超过几日常用量
A. 2日
B. 3日
C. 5日
D. 7日
E. 15日

正确答案：E。15日

解析：第一类精神药品注射剂，每张处方为一次常用量；控缓释制剂，每张处方不得超过7日常用量；其他剂型，每张处方不得超过3日常用量。哌醋甲酯用于治疗儿童多动症时，每张处方不得超过15日常用量。掌握“处方的开具、监督管理及法律责任”知识点。